治疗胃痛吐酸湿疮湿疹，应选用的药物是
A. 覆盆子
B. 海螵蛸
C. 金樱子
D. 芡实
E. 山茱萸

正确答案：B。海螵蛸

解析：海螵蛸味咸而涩，能制酸止痛，为治疗胃酸过多、胃痛吞酸之佳品。本品外用能收湿敛疮。治湿疮、湿疹（B对）。覆盆子治疗肾虚不固，遗精滑精，遗尿尿频，阳痿早泄；肝肾不足，目暗昏花（A错）。金樱子治疗遗精滑精，遗尿尿频，崩漏带下；久泻，久痢（C错）。芡实治疗肾虚遗精滑精，遗尿尿频；脾虚久泻；白浊，带下（D错）。山茱萸治疗肝肾亏虚，眩晕耳鸣，腰膝酸痛，阳痿；遗精滑精，遗尿尿频；月经过多，崩漏带下；大汗虚脱；内热消渴（E错）。